关于癌症病人三阶梯的治疗原则，正确的是
A. 轻度疼痛时给布桂嗪、氨酚待因、曲马多
B. 中度疼痛时给阿司匹林、布洛芬、二氢埃托啡
C. 重度疼痛时给咪美辛、布桂嗪、高乌甲素
D. 对晚期重度疼痛，应按时（3-6小时）按量（剂量直至疼痛消失）给药
E. 对晚期重度疼痛应按需（只在疼痛时）定量给药

正确答案：D。对晚期重度疼痛，应按时（3-6小时）按量（剂量直至疼痛消失）给药